入汤剂宜另煎的药物是
A. 人参
B. 当归
C. 黄芪
D. 杜仲
E. 石斛

正确答案：A。人参

解析：另煎主要是某些贵重药材，为了更好地煎出有效成分，应单独另煎。人参属贵重药材，为保证其煎出的有效成分不被其他药物饮片吸附，故单独另煎（A对）。当归、黄芪、杜仲、石斛为常用的普通药物，煎服即可（BCDE错）。